下列叙述中，正确的说法是
A. 颈总动脉分为颈内动脉和颈外动脉
B. 颈内静脉位于颈内动脉和颈总动脉的外侧
C. 颈总动脉在颈动脉三角的下部
D. 面总静脉最终汇入颈内静脉
E. 以上都正确

正确答案：E。以上都正确

解析：颈总动脉：在颈动脉三角的下部，从胸锁乳突肌的前缘露出，沿气管及喉的外侧上行，约平甲状软骨上缘处，分为颈内动脉和颈外动脉。颈内静脉位于颈内动脉和颈总动脉的外侧，在颈动脉三角内，仅在甲状软骨上缘平面以上，从胸锁乳突肌前缘露出少许。掌握“气管颈段、颈动脉三角的解剖特点及临床应用”知识点。